一种心理测量的工具称为
A. 心理评估
B. 心理鉴定
C. 心理测验
D. 心理观察
E. 心理调查

正确答案：C。心理测验

解析：本题考查心理测验。一种心理测量的工具称为心理测验（C对B错）。心理评估（A错）是依据心理学的理论和方法对人的心理品质及水平所作出的鉴定；所谓心理品质包括心理过程和人格特征等内容，如情绪状态、记忆、智力、性格等。心理观察（D错）是通过对被评估者的行为表现直接或间接（通过摄录像设备等）的观察或观测而进行心理评估的一种方法。心理调查（E错）有些资料不可能从当事人那里获得时，就要从相关的人或材料那里得到。